有关流感的人群易感性的描述不正确的是
A. 由于母体抗体的保护，新生儿的易感性较低
B. 人对流感病毒普遍易感
C. 老年人的易感性较低
D. 不同亚型之间有部分交叉免疫
E. 各型病毒之间无交叉免疫

正确答案：A。由于母体抗体的保护，新生儿的易感性较低

解析：本题考查流感的人群易感性的相关内容。人对流感病毒普遍易感（B对），男女之间易感性没有差别。各型流感病毒之间无交叉免疫（E对），不同亚型间仅有部分交叉免疫（D对）。新生儿因免疫功能尚未健全，加之母体通过胎盘传给新生儿的抗体较少，因此新生儿的易感性高（A错，为本题正确答案），感染后症状重，病死率高。老年人由于经历过各种亚型病毒的多次攻击，可能存在不同亚型间部分交叉免疫，易感性较低（C对）。但有慢性疾病的老年人感染后往往使病情加重，甚至导致死亡。